成人血清钠的正常值是
A. 110～120mmol/L
B. 121～130mmol/L
C. 135～145mmol/L
D. 150～155mmol/L
E. 156～160mmol/L

正确答案：C。135～145mmol/L

解析：成人血清钠的正常值是135～145mmol/L（C对）。